下面哪一个公式用于计算感染率
A. （某一时期内新病例数/同期平均人口数）×100%
B. （受检者中阳性人数/受检查人数）×100%
C. （受检查者中阳性人数/同期暴露人口数）×100%
D. （受检查者中阴性人数/受检者人数）×100%
E. （受检查者中阳性人数/同期平均人口数）×100%

正确答案：B。（受检者中阳性人数/受检查人数）×100%

解析：本题考查感染率的概念。感染率是指在某时间内被检人群中某病原体现有感染者人数所占的比例，通常用百分率表示。感染率的公式为：感染率＝（受检者中阳性人数/受检查人数）×100%（B对ACDE错）。